顶盖前区参与
A. 痛觉反射
B. 听觉反射
C. 瞳孔对光反射
D. 角膜反射
E. 触觉反射

正确答案：C。瞳孔对光反射

解析：顶盖前区是瞳孔对光反射（C对）的反射中枢。瞳孔对光反射的通路如下：视网膜—视神经一视交叉一视束一上丘臂一顶盖前区一两侧动眼神经副核一动眼神经一睫状神经节一节后纤维一瞳孔括约肌收缩一两侧瞳孔缩小。